缺乳因失血过多所致者，应配合
A. 中脘、足三里
B. 太冲、三阴交
C. 中脘、天枢
D. 肝俞、膈俞
E. 期门、太冲

正确答案：D。肝俞、膈俞

解析：缺乳因失血过多配穴为肝俞、膈俞。肝俞乃肝之背俞穴，有疏肝理气之作用；膈俞理气宽胸，活血通脉（D对）。中脘为胃之募穴，腑之所会，可健运中州，调理气机；足三里为足阳明合穴、胃之下合穴，可扶土而补中气（A错）。太冲属于足厥阴肝经，平肝息风，清热利湿，通络止痛；三阴交为三阴经交会穴，可健脾利湿。（B错）。中脘为胃之募穴，腑之所会，可健运中州，调理气机；天枢为大肠募穴，理气止痛，活血散瘀，清利湿热（C错）。期门为肝经募穴，健脾疏肝，理气活血；太冲平肝息风，清热利湿，通络止痛（E错）。